感受寒邪症见恶寒或畏寒，是由于
A. 寒为阴邪，伤人阳气
B. 寒性凝滞，气血阻滞不通
C. 寒伤肌表，卫阳被遏
D. 寒性收引，经脉拘急
E. 寒性黏滞，气机不畅

正确答案：A。寒为阴邪，伤人阳气

解析：感受寒邪，最易损伤人体阳气。如外寒侵袭肌表，卫阳被遏，可见恶寒发热，无汗，鼻塞喷嚏等症（A对）。寒性凝滞，易使气血津液凝结、经脉阻滞不通，不通则痛，故疼痛是寒邪致病的重要临床表现（B错）。寒伤肌表，卫阳被遏不是寒邪的性质和致病特点（C错）。寒性收引指寒邪侵袭人体，可使气机收敛，腠理、经络、筋脉收缩而挛急。寒克经络关节，则经脉收缩拘急，甚则挛急作痛，屈伸不利，或冷厥不仁可知（D错）。寒邪凝滞，湿邪黏滞（E错）。